水溶性物质借助细胞膜上载体蛋白或通道蛋白的帮助进入细胞的过程是
A. 单纯扩散
B. 易化扩散
C. 主动转运
D. 入胞作用
E. 出胞作用

正确答案：B。易化扩散